患者，女,38岁，心悸6年，善惊易恐，坐卧不安，多梦易醒，舌苔薄白，脉虚数。其辩证是
A. 心血亏虚证
B. 阴虚火旺证
C. 心虚胆怯证
D. 血脉瘀阻证
E. 水引凌心证

正确答案：C。心虚胆怯证

解析：患者为心悸病，心悸病分八个证型，分别为心虚胆怯证、心血不足证、阴虚火旺证、心阳不振证、水饮凌心证、瘀阻心脉证、痰火扰心证、邪毒犯心证。患者血虚、阴虚症状不明显（AB错）、无血瘀、水饮症状（DE错），而善惊易恐，坐卧不安，多梦易醒，心胆气虚，故为心虚胆怯证（C对）。